患者47岁，近二年月经周期紊乱，血量多，此次又阴道流血20余天，伴头晕，心悸，查体：轻度贫血貌，子宫、附件正常假如该病人病理结果为子宫内膜重度不典型增生，下一步治疗应为
A. 观察经过
B. 全子宫切除
C. 再次刮宫
D. 放疗
E. 全子宫+双附件+盆腔淋巴结切除

正确答案：B。全子宫切除

解析：患者目前只是重度不典型增生，没有发展到浸润癌，不需要进行淋巴结清扫。故选B。掌握“功能失调性子宫出血”知识点。